二氢吡啶环上，3位取代基为甲酸甲氧基乙酯的药物是
A. 氨氯地平
B. 尼卡地平
C. 硝苯地平
D. 尼群地平
E. 尼莫地平

正确答案：E。尼莫地平